消除支气管哮喘气道炎症最有效的药物是
A. 糖皮质激素
B. 抗生素
C. 抗组胺药
D. β2受体激动剂
E. 色甘酸钠

正确答案：A。糖皮质激素

解析：支气管哮喘实质是慢性气道炎症，抗炎治疗首选吸入糖皮质激素，糖皮质激素是当前防治哮喘最有效的药物。主要作用机制是抑制炎症细胞的迁移和活化；抑制细胞因子的生成；抑制炎症介质的释放；增强平滑肌细胞β2受体的反应性（A对）。抗生素（B错）是抗菌药，当哮喘合并其他感染时使用。抗组胺药（C错）常用于抗过敏。β2受体激动剂（D错）属于缓解性药物，通过迅速解除支气管痉挛从而缓解哮喘症状，亦称解痉平喘药。色甘酸钠（E错）常用于预防过敏哮喘的发作。